经过检测，某食物每百克视黄醇当量为310μg，能量138kcal。现已知推荐的每日膳食中营养素供给量，成年轻体力劳动者视黄醇当量为800μg，能量为2600kcal。INQ值为
A. 0.137
B. 0.5727
C. 1
D. 1.7461
E. 7.3

正确答案：E。7.3